当城镇内主要是六层建筑物时，所需最小服务水头为
A. 18m
B. 20m
C. 24m
D. 28m
E. 30m

正确答案：D。28m

解析：本题考查城镇最小服务水头规定。城镇最小服务水头规定：一层建筑物为10m、二层12m、二层以上每增加一层增加4m，当城镇内主要是六层建筑物时，所需最小服务水头为28m（D对ABCE错）。